以下哪条动脉不是直接由腹主动脉发出的
A. 肾上腺中动脉
B. 腹腔干
C. 肾动脉
D. 子宫动脉
E. 卵巢动脉

正确答案：D。子宫动脉

解析：肾上腺中动脉（A对）、腹腔干（B对）、肾动脉（C对）、卵巢动脉（E对）均为直接由腹主动脉发出的分支。子宫动脉（D错，为本题正确答案）为髂内动脉的分支。